男，50岁。无明显诱因出现左肩，上臂，前臂外侧放射痛3个月。既往体健。查体：T36.6℃，P82次/分，BP110/60mmHg，双肺呼吸音清，未闻及干湿性啰音，心律齐，未闻及杂音，腹软，无压痛，未触及包块，肩关节活动正常，上肢感觉及肌力均正常。Eaton试验和Spurling试验阳性。首先考虑的诊断是
A. 冈上肌腱炎
B. 肩峰撞击综合征
C. 肩袖损伤
D. 神经根型颈椎病
E. 粘连性肩关节囊炎

正确答案：D。神经根型颈椎病

解析：老年男性患者，无明显诱因出现左肩，上臂，前臂外侧放射痛3个月；查体：T36.6℃（体温正常值36℃～37.3℃），P82次/分（正常60～100次/分），BP110/60mmHg（正常值90～120/60～80mmHg），双肺呼吸音清，未闻及干湿性啰音。肩关节活动正常，压头试验阳性（Spurling征），牵拉试验阳性（Eaton试验）等均为神经根型颈椎病（D对）的典型表现。冈上肌肌腱炎（又称冈上肌综合征）（A错），是指劳损和轻微外伤或受寒后逐渐引起的肌腱退行性改变。好发于中青年及以上体力劳动者（如家庭妇女、运动员），常表现为肩关节活动受限。肩峰撞击综合征（B错）（P720）多表现为夜间肩外侧痛，患肢外展、上举障碍。（该患者肩关节活动正常）。肩袖损伤（C错）常发生于60岁以上老人，表现为肩颈痛，典型“落臂征”，超声、MRI有肩袖撕裂特征表现。粘连性肩关节囊炎（E错）（P720）又称肩周炎，主要痛点在肩关节周围，影响肩关节活动。以肩峰大结节处为主的疼痛，并可向颈、肩和上肢放射。肩外展时疼痛尤著，因而病人常避免这一动作。